县级以上地方各级人民政府卫生行政部门对公共场所的监督职责，不包括
A. 进行卫生监测和卫生技术指导
B. 监督从业人员健康检査
C. 对新建、扩建、改建的公共场所的选址和设计进行卫生审查
D. 制定公共场所危害健康事故应急预案
E. 对违反《公共场所卫生管理条例》的单位和个人进行行政处罚

正确答案：D。制定公共场所危害健康事故应急预案